神经衰弱的记忆力减退是由于
A. 睡眠障碍
B. 思维迟钝
C. 情绪不稳
D. 注意力难以集中
E. 焦虑不安

正确答案：D。注意力难以集中

解析：神经衰弱表现为记忆力减退，其根本原因在于注意力分散，不能集中（D对）。神经衰弱常表现：①精神易兴奋和脑力易疲乏；②紧张性疼痛；③睡眠障碍；④肌肉疼痛感；⑤易激惹；⑥情感脆弱。